血清抗体测定
A. 免疫荧光法和FACS分析
B. ELISA
C. 混合淋巴细胞培养
D. 51Cr释放实验
E. 淋巴细胞转化实验

正确答案：B。ELISA